终池属于下列哪一项构成的结构
A. 硬脊膜和前、后纵韧带之间的间隙
B. 蛛网膜和软脊膜之间的间隙
C. 蛛网膜和硬脊膜之间的间隙
D. 硬脊膜和软脊膜之间的间隙
E. 无

正确答案：B。蛛网膜和软脊膜之间的间隙

解析：脊髓的被膜由外向内为硬脊膜、脊髓蛛网膜和软脊膜。其中，终池位于蛛网膜与软脊膜之间的间隙（B对）。